积极防治错（牙合）畸形的是
A. 婴儿
B. 幼儿
C. 学龄儿童
D. 青壮年
E. 老年人

正确答案：C。学龄儿童

解析：本题考查错（牙合）畸形。积极防治错（牙合）畸形的是学龄儿童（C对）。学龄儿童指6、7岁至17、18岁整个普通教育阶段的学生。错（牙合）畸形是指在儿童生长发育过程中由于先天遗传因素或后天环境因素，导致牙、（牙合）、颌骨及颅面的畸形。因此，学龄儿童应积极防治错（牙合）畸形。学龄儿童常见口腔健康问题：第一恒磨牙龋、龈炎、错（牙合）畸形、牙外伤。